五味子中木脂素的主要结构类型是
A. 新木脂素
B. 厚朴酚木脂素
C. 联苯环辛烯型木脂素
D. 联苯环丁烷型木脂素
E. 内酯型木脂素

正确答案：C。联苯环辛烯型木脂素

解析：本题考查的是五味子中木脂素的结构类型。五味子中木脂素的主要结构类型是联苯环辛烯型木脂素（C对）。五味子中含木脂素较多，约为5%，近年来从其果实中分得了一系列联苯环辛烯型木脂素。《中国药典》采用高效液相色谱法测定药材中五味子醇甲的含量，要求不得少于0.40%。厚朴酚（B错）为厚朴的主要化学成分。厚朴中主要化学成分为木脂素类化合物，包括厚朴酚以及和厚朴酚等，《中国药典》采用高效液相色谱法测定药材中厚朴酚与和厚朴酚含量，两者总含量不得少于2.0%。新木脂素（A错）、联苯环丁烷型木脂素（D错）与内酯型木脂素（E错），2022年考试指南未明确说明。